在美国药剂师职业道德规范中强调，药剂师
A. 应加入以发展药学事业为目标的组织
B. 不能销售医疗器械
C. 不必扩大自己的专业知识
D. 没有义务维护其职业的荣誉
E. 无权要求保证自己服务质量的条件

正确答案：A。应加入以发展药学事业为目标的组织